吞服腐蚀性剂后最早出现和最明显的症状为
A. 口腔、咽喉、胸骨后及上腹部剧痛
B. 咽下困难、恶心、呕吐
C. 食管或胃穿孔
D. 休克
E. 呕血

正确答案：A。口腔、咽喉、胸骨后及上腹部剧痛